下列有关牙体缺损的影响正确的是
A. 美观
B. 发音
C. 功能
D. 心理状态
E. 以上说法均正确

正确答案：E。以上说法均正确

解析：牙体缺损可直接影响患者的功能、美观、发音和心理状态等。掌握“牙体缺损病因及影响”知识点。